男，45岁。进行性呼吸困难半年。咳嗽，咯血及胸痛。查体，BP110/75mmHg。口唇发绀，颈静脉怒张。双肺呼吸音清，心界无扩大，心率92次/分。P₂亢进，三尖瓣区可触及抬举样搏动。双下肢轻度水肿。为明确诊断，首选的检查是
A. 超声心动图
B. 心电图
C. 肺通气/灌注扫描
D. 肺功能
E. CT肺动脉造影

正确答案：E。CT肺动脉造影

解析：45岁男性患者，进行性呼吸困难半年（PTE常见症状），咳嗽、咯血及胸痛（PTE“三联征”），BP110/75mmHg（PTE血压一般无特异性改变），口唇发绀（缺氧，PTE呼吸系统常见体征），双肺呼吸音清，P₂亢进，三尖瓣区可触及抬举样搏动（肺动脉高压，PTE心脏检查常见体征），颈静脉怒张，心界无扩大，心率92次/分，双下肢轻度水肿（PTE继发右心功能障碍，出现体循环淤血体征），根据患者的临床表现、体征，首先考虑的诊断为肺栓塞（PTE），为明确诊断，首选的检查为CT肺动脉造影（E对），是最为有效、方便、便捷的一线确诊方法，能发现段叶上肺动脉内栓子，甚至发现深静脉栓子。PET心电图（B错）大多为非特异性改变，随病程的演变呈动态变化。超声心动图（A错）为患者确诊后应常规进行的检查，能提示肺动脉高压、右心室高负荷和肺源性心脏病，但尚不能作为PET确诊依据，可以发现右心、肺动脉主干内的血栓，同时提示PTE和除外其他心血管疾病，以及对进行性急性PTE危险度分层有重要价值。放射性核素肺通气/血流（V/Q）显像（C错）是PTE的重要诊断方法，对远端肺栓塞的诊断价值更高，用于肾功能不全和造影剂过敏患者。肺功能（D错）主要用于COPD的诊断，不作为PTE的常规检查。